四神丸的组成药物中含有
A. 草豆蔻
B. 白豆寇
C. 肉豆寇
D. 砂仁
E. 厚朴

正确答案：C。肉豆寇

解析：四神丸组成为肉豆蔻（C对）、补骨脂、五味子、吴茱萸、生姜、大枣（四神故纸吴茱萸，肉蔻五味四般需，大枣百枚姜八两，五更肾泄火衰扶）。